最常用于诊断甲状腺癌及口腔内异位甲状腺可应用
A. 99mTc
B. 125I
C. 32P
D. 85Sr
E. 113In

正确答案：B。125I

解析：甲状腺癌及口腔内异位甲状腺可应用131I或125I诊断，125I分辨较好。掌握“口腔颌面部肿瘤的概念、临床表现、诊断”知识点。